因事故大量吸入氯乙烯后，主要毒作用表现是
A. 中枢神经系统的麻醉作用
B. 肢端溶骨症
C. 过敏性支气管哮喘
D. 聚合物烟雾热
E. 呼吸道刺激作用

正确答案：A。中枢神经系统的麻醉作用

解析：本题考查氯乙烯毒作用表现。当因事故大量吸入氯乙烯后，主要是对中枢神经系统呈现麻醉（A对BCDE错）作用。轻度中毒者有眩晕、头痛、乏力、恶心、胸闷、嗜睡、步态踉跄等。重度中毒可出现意识障碍，可有急性肺损伤甚至脑水肿的表现，严重病人可持续昏迷甚至死亡。